下列那项不属于小儿五软
A. 头项软
B. 腰膝软
C. 肌肉软
D. 手软
E. 足软

正确答案：B。腰膝软

解析：小儿五软是小儿生长发育障碍的病证，五软指头项软（A对）、口软、手软（D对）、足软（E对）、肌肉软（C对），可与五迟同时存在，故腰膝软（B错，为本题正确答案）不属于五软。